一名牙周病患者，戴心脏起搏器，禁止做下列哪一项治疗
A. 龈下刮治术
B. 超声洁牙术
C. 袋壁搔刮术
D. 调（牙合）
E. 钢丝结扎术

正确答案：B。超声洁牙术

解析：本题考查超声波龈上洁治的注意事项。一名牙周病患者，戴心脏起搏器，禁止做超声洁牙术（B错，为本题的正确答案）。超声波洁治禁用于置有旧式心脏起搏器的患者，以免因电磁辐射的干扰造成眩晕及心律失常等症状。新型起搏器具有屏障功能，不会受超声波洁治的干扰，戴用这类起搏器的患者不在禁用之列。对于有肝炎、肺结核、艾滋病等传染性疾病者也不宜使用超声洁牙，以免血液和病原菌随喷雾而污染诊室环境。龈下刮治术（A对）、袋壁搔刮术（C对）、调（牙合）（D对）以及钢丝结扎术（E对）均可。